呼吸衰竭时最常发生的酸碱平衡紊乱是
A. 代谢性酸中毒
B. 呼吸性酸中毒
C. 代谢性碱中毒
D. 呼吸性碱中毒
E. 混合性酸碱紊乱

正确答案：E。混合性酸碱紊乱

解析：呼吸衰竭时最常发生的酸碱平衡紊乱是混合性酸碱紊乱（E对）。